女，68岁。夜尿增多2年，乏力3个月，既往因头痛长期服用去痛片10余年，否认高血压病糖尿病病史。查体：BP125/80mmHg，双下肢水肿。尿比重1.008，RBCO～1/HP，尿蛋白（+），尿糖（++），血Hb80g/L，Cr265μmol/L，Glu5.5mmol/L，该患者肾功能不全最可能的原因是
A. 缺血性肾病
B. 糖尿病肾病
C. 慢性肾小球肾炎
D. 肾小管间质肾病
E. 慢性肾盂肾炎

正确答案：D。肾小管间质肾病

解析：老年女性患者，服止痛药10余年（肾小管间质肾病的病因之一），否认高血压病糖尿病病史。夜尿增多2年（远端肾小管浓缩功能受损），乏力3个月，查体：BP125/80mmHg，双下肢水肿。尿比重1.008（正常值1.010～1.025）（提示远端肾小管浓缩功能受损），尿蛋白（+），尿糖（++）（前已提及患者无糖尿病病史，考虑近端肾小管重吸收功能障碍），血Hb80g/L（中度贫血），Cr265μmol/L【正常值（女）70～108μmol/L】（提示肾小球功能受损），Glu5.5mmol/L（正常范围，印证了患者无糖尿病可能）。综合患者的既往史、临床表现以及实验室检查，考虑镇痛药引起的肾小管间质肾病（D对）。止痛剂代谢产物在肾髓质中高度浓缩，直接损害肾小管上皮细胞膜，引起肾小管间质慢性炎症，首先损伤远端肾小管的浓缩功能及近端肾小管的重吸收功能，而后损伤肾小球的功能，且可出现肾性贫血及高血压。缺血性肾病（A错）常由动脉粥样硬化及大动脉炎所致的肾动脉狭窄引起，临床表现跟本题患者类似，可伴或不伴高血压，体查可闻及腹部或腰部血管杂音（P501）。糖尿病肾病（B错）发生在多年糖尿病病史后，患者否认糖尿病病史，虽有尿糖，但血糖检查正常，证明患者确无糖尿病，应为肾性尿糖。慢性肾小球肾炎（C错）多以肾小球功能受损（即蛋白尿、血尿）而不是肾小管功能受损（如夜尿增多、尿比重降低等）为首发表现。慢性肾盂肾炎（E错）表现为反复发作的尿路刺激症和间歇性细菌尿，患者并没有出现相关症状。